下列不属于牙本质的反应性改变的为
A. 修复牙本质
B. 透明牙本质
C. 罩牙本质
D. 骨样牙本质
E. 硬化牙本质

正确答案：C。罩牙本质

解析：牙本质的间质为矿化的间质，其中在冠部靠近釉质最先形成的牙本质为罩牙本质。掌握“牙本质”知识点。